通便宁片除能泻下通便外，又能
A. 滋阴补肾
B. 泻热导滞
C. 宽中理气
D. 增液润燥
E. 健脾利湿

正确答案：C。宽中理气

解析：本题考查通便宁片的功能。通便宁片除能泻下通便外，又能宽中理气（C对）。通便宁片【功能】宽中理气，泻下通便。苁蓉通便口服液【功能】滋阴补肾（A错），润肠通便。通便灵胶囊【功能】泻热导滞（B错），润肠通便。增液口服液【功能】养阴生津，增液润燥（D错）。尿毒清颗粒【功能】通腑降浊，健脾利湿（E错），活血化瘀。